肛梳下缘处，肛门指诊时可触及一环行浅沟，此位置相当于
A. 齿状线
B. 白线
C. 肛窦
D. 肛梳
E. 肛管的上界即直肠穿盆膈的平面

正确答案：B。白线

解析：肛门指诊时在肛梳下缘处触及的环行浅沟为括约肌间沟，此处有一环行线为白线(B对)。齿状线(A错)为连接各肛柱下端与各肛瓣边缘的锯齿状环行线，肛窦(C错)为肛瓣与其相邻的两个肛柱下端之间形成开口向上的隐窝。